27岁初孕妇，妊娠38周，患重度妊娠高血压综合征，昨晚突然出现阴道流血伴下腹痛，最可能的诊断应是
A. 前置胎盘
B. 羊水过多
C. 胎盘早剥
D. 先兆子宫破裂
E. 子宫破裂

正确答案：C。胎盘早剥

解析：青年初孕妇，妊娠38周（28周及以后为妊娠晚期），患重度妊娠高血压综合征（为胎盘早剥发生的高危因素），突然出现阴道流血伴下腹痛（胎盘早剥的典型表现为腹痛伴或不伴阴道流血），故最可能的诊断是胎盘早剥（C对）。前置胎盘（P127）（A错）典型症状为妊娠晚期或临产时，发生无诱因、无痛性反复阴道流血。羊水过多（P136）（B错）多发生在20～24周，表现为一系列压迫症状，如行动不便，因横隔抬高，出现呼吸困难，甚至发绀，不能平卧等，无阴道流血的表现。先兆子宫破裂（P218）（D错）多发生在分娩期，常见于产程长、有梗阻性难产因素的产妇，表现为子产妇烦躁不安，呼吸、心率加快，下腹剧痛难忍，出现少量阴道流血。